栀子的药理作用有
A. 降血压
B. 抗肿瘤
C. 抗菌抗炎
D. 镇静镇痛
E. 保肝利胆

正确答案：A、C、D、E。降血压；抗菌抗炎；镇静镇痛；保肝利胆

解析：本题考查栀子的药理作用。栀子的药理作用有降血压（A对）、抗菌抗炎（C对）、镇静镇痛（D对）、保肝利胆（E对）。栀子的药理作用有降血压、抗菌抗炎、镇静镇痛、保肝利胆。防己的药理作用：防己生物碱具有抗炎、镇痛、抗肿瘤（B错）的作用等，同时具有调节免疫力和耐缺氧的作用等。